医生实施的特殊干涉权的适用范围不包括
A. 对精神病患者意志丧失和自杀未遂等患者拒绝治疗时
B. 患者要求了解自己的病情，但了解后不利于诊断治疗时
C. 患者要求了解自己疾病的真情，但有可能产生不良影响时
D. 进行人体实验过程中，为实验保守秘密时
E. 患者虽然对进行的实验性治疗知情同意但如出现高危情况时

正确答案：D。进行人体实验过程中，为实验保守秘密时

解析：医生实施的特殊干涉权的适用范围不包括，进行人体实验过程中，为实验保守秘密时。人体实验性治疗人体实验必须经受试者知情同意。但一些高度危险或可能致死致残的实验，即使患者出于某种目的同意，如渴望通过虽有高风险但也可能有很好疗效的实验，使疾病特别是某些缺乏有效方法的疾病得以痊愈；或纯粹出于经济目的等，但医生通过检查认为，患者的健康状况不适宜进行这些高度危险的医学实验，可以适时干预；必要时停止或中断实验，以保护患者利益（D错，为本题正确答案）。